牙髓感染发生最多、最主要的途径
A. 由冠方经牙体感染
B. 从牙根逆向感染
C. 急性创伤
D. 物理刺激
E. 化学刺激

正确答案：A。由冠方经牙体感染

解析：本题考查牙髓疾病的病因及分类。由冠方经牙体感染（A对）：这是牙髓感染发生最多、最主要的途径。当釉质或牙骨质的完整性被破坏时，细菌可由暴露于口腔中的牙本质小管进入牙髓；当牙髓腔暴露，细菌也可直接侵入裸露的牙髓，引发牙髓感染。